外淋巴位于
A. 骨迷路与颞骨骨质之间
B. 中耳鼓室与内耳外侧壁之间
C. 蜗管与椭圆球囊管内
D. 骨迷路与膜迷路之间
E. 以上均不正确

正确答案：D。骨迷路与膜迷路之间

解析：骨迷路与膜迷路之间充满外淋巴（D对）。蜗管与椭圆球囊是膜迷路的组成部分，充满内淋巴（C错）。